阴茎海绵体部后端分离称
A. 阴茎海绵体
B. 尿道海绵体
C. 阴茎头
D. 尿道球
E. 阴茎脚

正确答案：E。阴茎脚

解析：阴茎脚（E对）为阴茎海绵体部后端分离形成，附于两侧的耻骨下支和坐骨支。